应用一种筛选乳腺癌的试验，检查经活检证实患有乳腺癌的1000名妇女和未患乳腺癌的1000名妇女，检查结果患癌组中有900名得阳性结果，未患病组中有100名阳性，该试验筛选试验其阴性预测值是
A. 0.9
B. 0.1
C. 0.25
D. 0.3
E. 0.12

正确答案：A。0.9

解析：本题考查阴性预测值的计算。阴性预测值＝真阴性/（真阴性＋假阴性）×100%＝900/1000×100%＝90%（A对BCDE错）。